化学毒物体内生物转化Ⅰ相反应的酶主要存在于
A. 内质网
B. 线粒体
C. 细胞膜
D. 细胞核

正确答案：A。内质网

解析：本题考查化学毒物体内生物转化Ⅰ相反应的酶主要存在部位。化学毒物体内生物转化Ⅰ相反应的酶主要存在于内质网（A对BCD错）。